既收敛止血，又截疟止痢的药是
A. 大蓟
B. 紫珠
C. 槐花
D. 白及
E. 仙鹤草

正确答案：E。仙鹤草